清宁丸除消肿通便外，又能
A. 凉血利咽
B. 清热泻火
C. 清热化湿
D. 清热疏风
E. 清热利尿

正确答案：B。清热泻火

解析：本题考查清宁丸的功能。清宁丸除消肿通便外，又能清热泻火（B对）。清宁丸【功能】清热泻火，通便。板蓝根颗粒：【功能】清热解毒，凉血利咽（A错）。香连丸：【功能】清热化湿（C错），行气止痛。感冒清热颗粒：【功能】疏风散寒，解表清热（D错）。肾炎四味片：【功能】清热利尿（E错），补气健脾。